下面哪种论述是错误的
A. 窒息性气体均易引起机体缺氧
B. 高浓度刺激性气体可引起肺水肿
C. 易挥发的有机溶剂可引起中枢神经的抑制或麻痹
D. 氰化氢中毒临床经过分为前驱期和呼吸困难期两期
E. 铅中毒时早期有乏力、口内金属味、肌肉关节酸痛等表现

正确答案：D。氰化氢中毒临床经过分为前驱期和呼吸困难期两期